关于手掌动脉弓，错误的说法是
A. 掌浅弓凸缘发出3条掌心动脉
B. 掌深弓凸缘发出3条掌心动脉
C. 掌浅弓由尺动脉终支和桡动脉的掌浅支构成
D. 掌深弓由桡动脉终支和的尺动脉掌深支构成
E. 掌深、浅弓借动脉互相吻合

正确答案：A。掌浅弓凸缘发出3条掌心动脉

解析：掌浅弓上发出三条指掌侧总动脉（A错，为本题正确答案）和一条小指尺掌侧动脉。掌深弓凸缘发出3条掌心动脉（B对）。掌浅弓由尺动脉的末端与桡动脉的掌浅支吻合而成（C对）。掌深弓由桡动脉的末端与尺动脉的掌深支吻合而成（D对）。掌深、浅弓借动脉互相吻合（E对）。